目前所知唯一含有金属元素的维生素是
A. 维生素B₁缺乏
B. 维生素B₂缺乏
C. 维生素B₁₂缺乏
D. 维生素C缺乏
E. 维生素K缺乏

正确答案：C。维生素B₁₂缺乏

解析：维生素B₁₂含钴（Co），又称为钴胺素，是目前所知唯一含有金属元素的维生素。掌握“水溶性维生素”知识点。